一臀位娩出婴儿，生后发现左大腿肿胀缩短畸形，并有异常活动。为确定诊断首选的检查是
A. 血常规
B. 出凝血时间
C. X线片
D. CT
E. MRI

正确答案：C。X线片

解析：患儿有臀位娩出史，左大腿缩短畸形、有异常活动（畸形、异常活动为骨折的特有体征），应怀疑为经产道后左股骨干骨折。为确定诊断，首选的检查是X线（C对）（X线平片目前仍是骨折特别是四肢骨折最常用的和行之有效的检查方法，对骨折的诊断和治疗具有重要价值）。CT（D错）对早期、不典型病例及复杂解剖部位骨折的临床意义较大，但CT费用昂贵，一般不作为骨折的首选检查。MRI（E错）对软组织层次显示效果好，能发现X线及CT未能发现的隐匿性骨折，但价格昂贵一般不作为骨折的首选检查。血常规（A错）、出凝血时间（B错）无特异性，对于骨折的诊断意义不大。